具有调理吞噬作用的补体裂解产物是
A. C2b
B. C3b
C. C5b
D. C2a
E. C4a

正确答案：B。C3b

解析：调理吞噬：C3b/C4b可结合细菌或真菌使其更容易被表达补体受体的吞噬细胞吞噬。掌握“补体功能及其与疾病的关系”知识点。